某女，55岁，面色萎黄，唇甲色淡，头晕眼花，脉细。医师辨证后处方为四物合剂。为减少服药品种，针对患者气血两虚之证，宜选用的成药是
A. 生脉饮
B. 左归丸
C. 八珍颗粒
D. 六君子丸
E. 七制香附丸

正确答案：C。八珍颗粒

解析：本题考查的是八珍颗粒的主治。为减少服药品种，针对患者气血两虚之证，宜选用的成药是八珍颗粒（C对）。八珍颗粒：【主治】气血两虚，面色萎黄，食欲不振，四肢乏力，月经过多。生脉饮（A错）：【主治】气阴两亏，心悸气短，脉微自汗。左归丸（B错）：【主治】真阴不足，腰酸膝软，盗汗遗精，神疲口燥。六君子丸（D错）：【主治】脾胃虚弱，食量不多，气虚痰多，腹胀便溏。七制香附丸（E错）：【主治】气滞血虚所致的痛经、月经量少、闭经，症见胸胁胀痛、经行量少、行经小腹胀痛、经前双乳胀痛、经水数月不行。